主要由自身反应性T细胞介导的自身免疫性疾病是
A. 链球菌感染后肾小球肾炎
B. 系统性红斑狼疮
C. 肺出血-肾炎综合征
D. 血小板减少性紫癜
E. 多发性硬化

正确答案：E。多发性硬化

解析：多发性硬化症（MS）是一种免疫介导的中枢神经系统慢性炎性脱髓鞘性疾病，MS的发病机制迄今不明，但推测与自身反应T细胞介导的自身免疫攻击有关（E对）；链球菌感染后的肾小球肾炎，多见于链球菌感染后1-4周之后，损伤主要由免疫复合物介导（A错）；系统性红斑狼疮是由抗核抗体为主的多种自身抗体引起的自身免疫病，该病主要由活动亢进的B细胞介导（B错）；肺出血-肾炎综合征属于Ⅰ型急进性肾小球肾炎，主要由肾小球抗基底膜抗体引起（C错）；血小板减少性紫癜，发病机制与体液免疫和细胞免疫介导的血小板过度破坏有关（八版内科学P624），主要由血小板膜糖蛋白特异性自身抗体介导（D错）。